固定不变的弯曲
A. 尿道内口
B. 尿道外口
C. 尿道膜部
D. 尿道耻骨下弯
E. 尿道耻骨前弯

正确答案：D。尿道耻骨下弯

解析：男性尿道有两个弯曲，耻骨下弯（D对）为固定不变的弯曲，当阴茎勃起或将阴茎向上提起时，耻骨前弯（E错）可变直而消失。